方中人参玄参丹参同用的方剂是.
A. 清营汤
B. 天王补心丹
C. 百合固金汤
D. 清燥救肺汤
E. 朱砂安神丸

正确答案：B。天王补心丹

解析：天王补心丹含有酸枣仁、柏子仁、当归身、天门冬、麦门冬、生地黄、人参、丹参、玄参、白茯苓、五味子、远志、桔梗以滋阴养血，补心安神（B对）。清营汤含有犀角、生地、银花、连翘、元参、黄连、竹叶心、丹参、麦冬（A错）。百合固金汤含有熟地、生地、归身、白芍、甘草、桔梗、玄参、贝母、麦冬、百合（C错）。清燥救肺汤含有桑叶、石膏、甘草、胡麻仁、真阿胶、枇杷叶、人参、麦门冬、杏仁（D错）。朱砂安神丸含有朱砂、黄连、炙甘草、生地黄、当归（E错）。方歌：补心丹用柏枣仁，二冬生地当归身，三参桔梗朱砂味，远志茯苓共养神。